大量的原料药物固体粉末（一般是25%以上）均匀地分散在适宜的基质中所组成的半固体外用制剂是
A. 凝胶贴膏
B. 糊剂
C. 涂剂
D. 凝胶剂
E. 涂膜剂

正确答案：B。糊剂

解析：本题考查糊剂的概念。糊剂（B对）系指大量的原料药物固体粉末（一般25%以上）均匀地分散在适宜的基质中所组成的半固体外用制剂。可分水溶性糊剂和脂溶性糊剂。凝胶贴膏（A错）系指原料药物与适宜的亲水性基质混匀后涂布于背衬材料上制成的贴膏剂。涂剂（C错）系指含原料药物的水性或油性溶液、乳状液、混悬液，供临用前用消毒纱布或棉球等柔软物料蘸取涂于皮肤或口腔与喉部黏膜的液体制剂。也可为临用前用无菌溶剂制成溶液的无菌冻干制剂，供创伤面涂抹治疗用。凝胶剂（D错）系指原料药物与能形成凝胶的辅料制成的具凝胶特性的稠厚液体或半固体制剂。除另有规定外，凝胶剂限局部用于皮肤及体腔，如鼻腔、阴道和直肠。涂膜剂（E错）系指原料药物溶解或分散于含成膜材料的溶剂中，涂搽患处后形成薄膜的外用液体制剂。